患者，女，45岁。因急腹症入院，诊断为化脓性胆囊炎穿孔并发绿脓杆菌性腹膜炎。既往有青霉素过敏史。抗感染治疗应选用
A. 羧苄青霉素
B. 头孢氨苄
C. 红霉素
D. 氯林可霉素
E. 环丙沙星

正确答案：E。环丙沙星

解析：中年女性患者，急腹症入院，诊断为化脓性胆囊炎穿孔并发绿脓杆菌性腹膜炎，既往有青霉素过敏史。环丙沙星（E对）属于氟喹诺酮类抗生素，对铜绿假单胞菌、流感嗜血杆菌、大肠埃希菌等革兰阴性菌的抗菌活性高于多数氟喹诺酮类药物，故适用于该患者。氯林可霉素（D错）属于林可霉素类抗生素，主要用于葡萄球菌、化脓性链球菌、肺炎球菌及厌氧菌所致的呼吸道感染。羧苄青霉素（A错）、头孢氨苄（B错）均与青霉素有相似之处，患者既往有青霉素过敏史，故两者禁用。红霉素（C错）属于大环内酯类抗生素，主要用于链球菌感染所引起的扁桃体炎、猩红热等。